疹的主要特点是
A. 色深红或青紫
B. 平铺于皮肤
C. 抚之碍手
D. 压之不褪色
E. 点大成片

正确答案：C。抚之碍手

解析：该题考查望诊望皮肤的内容。皮肤病症中的斑疹虽常常并称，但有实质性区别，主要表现在斑点大成片，平铺于皮肤，抚之不碍手，压之不退色而疹为粟粒状疹点，高出皮肤，抚之碍手，压之退色（C对ABDE错）。